茎突舌骨肌的主要功能是牵引舌骨向
A. 后上方
B. 后下方
C. 前下方
D. 前左方
E. 前右方

正确答案：A。后上方

解析：茎突舌骨肌：茎突舌骨肌的主要功能是牵引舌骨向后上方，是颏舌骨肌的拮抗肌。由面神经的二腹肌肌支支配。掌握“咀嚼肌、颈部肌及口颌系统肌链”知识点。